病人在不进食的情况下一般采取
A. 肠内营养
B. 肠外营养
C. 外科补液
D. 静脉输液
E. 胃肠造瘘

正确答案：B。肠外营养

解析：肠外营养（PN）也称人工胃肠，指通过静脉途径提供患者所需的全部营养要素的营养支持方式，包括热量（碳水化合物）、必需和非必需氨基酸（蛋白质）、脂肪、电解质、维生素和微量元素，使病人在不进食的情况下维持良好营养状态的一种治疗方法（B对）。肠内营养（EN）是将营养物质经胃肠道途径供给病人的营养支持方式。当肠功能存在（完好或部分功能）且能安全使用时，就应尽量选用经胃肠营养支持（A错）。外科补液的三大目的：补充水电解质，维持水和电解质平衡；维持有效血容量，保证循环状态稳定；补充糖、蛋白质、脂肪乳、维生素、微量元素等，为机体提供必要的营养成分（C错）。静脉输液主要有三大作用：1.注射疾病所需要的药物。2.提供营养物质。3.提供水分和电解质（D错）。胃肠造瘘是通过手术的方法在胃做一个人工外口与腹壁之间建立一个通道，用于灌注食物和进行治疗，以解决进食和营养问题或作为腹部手术后的减压（E错）。